心力衰竭治疗中限制输液是为了
A. 降低心脏前负荷
B. 降低心脏后负荷
C. 两者均有
D. 两者均无
E. 无

正确答案：A。降低心脏前负荷

解析：减轻心脏前后负荷是心衰防治原则之一，对于有水钠潴留的心衰患者，应限制输液，使静脉回心血量减少以降低心室舒张期充盈压，从而降低心脏收缩前承受的负荷（前负荷）（A对）。